O2与Hb结合后引起Hb构象变化，进而引起蛋白质分子功能改变的现象，称为
A. 协同效应
B. 化学修饰
C. 激活效应
D. 共价修饰
E. 别构效应

正确答案：E。别构效应

解析：当第一个O2与Hb结合成氧合血红蛋白（HbO2）后，发生构象改变犹如松开了整个Hb分子构象的“扳机”，导致第二、第三和第四个O2很快的结合。这种带O2的Hb亚基协助不带O2亚基结合氧的现象，称为协同效应。O2与Hb结合后引起Hb构象变化，进而引起蛋白质分子功能改变的现象，称为别构效应。掌握“蛋白质结构与功能关系”知识点。